65岁男性，因右上肢放射痛伴手指麻木，动作不灵活2年就诊。检查发现颈肩部压痛，神经牵拉试验及压头试验阳性，右上肢桡侧皮肤感觉减退，握力减弱，肌张力减低。最可能的诊断是
A. 交感神经型颈椎病
B. 脊髓型颈椎病
C. 椎动脉型颈椎病
D. 神经根型颈椎病
E. 混合型颈椎病

正确答案：D。神经根型颈椎病

解析：患者右上肢放射痛伴手指麻木、动作不灵活（神经根型颈椎病典型表现），颈肩部压痛，右上肢桡侧皮肤感觉减退、握力减弱、肌张力减低和神经牵拉试验及压头试验阳性（神经根型颈椎病典型体征），故该患者最可能的诊断为神经根型颈椎病（D对）。神经根型颈椎病多由于颈椎间盘向侧方突出，压迫神经根所致，引起颈肩痛，并向该神经根所支配的上肢区域放射，同时可有上肢无力、手指动作不灵活的表现，体查可有牵拉试验（Eaton试验）及压头试验阳性（Spurling征）。交感神经型颈椎病（A错）主要表现为交感神经受刺激的症状，可为兴奋性也可为抑制性。脊髓型颈椎病（B错）主要由于颈椎退变结构压迫脊髓，使病人出现上肢或下肢麻木无力、僵硬、双足踩棉花感，足尖不能离地等表现，并呈进行性加重趋势，检查时有感觉障碍平面，肌力减退，四肢腱反射活跃或亢进，Hoffmann征、髌阵挛、踝阵挛及Babinski征等阳性。椎动脉型颈椎病（C错）主要表现为突发性眩晕而猝倒、偏头痛、听力减退或耳聋、视力障碍等。混合型颈椎病（E错）多有两种或多种类型症状同时出现。